消化吸收最主要的部位是
A. 胃
B. 十二指肠
C. 小肠
D. 大肠
E. 食管

正确答案：C。小肠